将生命质量评价应用于卫生投资的成本-效益分析，这里的效益指标通常采用
A. 存活年数
B. 生存年数
C. 期望寿命
D. 潜在减寿年数
E. 质量调整生存年数

正确答案：E。质量调整生存年数